居室进深与居室宽度之比不宜大于
A. 3∶2
B. 2∶1
C. 2∶2
D. 4∶3
E. 3∶1

正确答案：B。2∶1

解析：本题考查居室进深与居室宽度之比。居室进深指开设窗户的外墙内表面至对面墙壁内表面的距离。居室进深与室内日照、采光、通风和换气有关。居室进深大，远离外墙处的室内空气滞留，换气困难。一般居室进深与居室宽度之比不宜大于2∶1（B对ACDE错），以3∶2较为适宜。